关于左肾位置的描述，正确的是
A. 上端平第11胸椎体下线
B. 下端平第2腰椎体下线
C. 第12肋斜过后面上部
D. 上端平第12胸椎体
E. 下端平第3腰椎体下线

正确答案：A。上端平第11胸椎体下线

解析：左肾上端平第11胸椎体下线（A对，C错），下端平第2-3腰椎椎间盘（BE错），第12肋斜过左肾后面中部（C错）。